男，4岁。近3个月发现右侧腹部有一肿物，增长迅速。行经腹肾切除术，病理为肾母细胞瘤。术后首选的辅助治疗方法是
A. 化学治疗
B. 放射治疗
C. 生物治疗
D. 基因治疗
E. 中医药治疗

正确答案：B。放射治疗

解析：肾母细胞瘤又称肾胚胎瘤或Wilms瘤，是小儿最常见的恶性肿瘤，需早期应用手术、化疗和放疗综合治疗，以提高患者术后生存率，因此术前、术后均可辅以放化疗。由于肾母细胞瘤对放疗高度敏感，故术后首选的辅助治疗方法是放射治疗（B对A错）。生物治疗（C错）、基因治疗（D错）及中医药治疗（E错）对肾母细胞瘤的治疗在八版外科学中未提及。